年轻男患者既往健康，突然咯血400-500ml，查体及胸部X线片无明显异常，你认为该患者最可能的诊断是
A. 支气管内膜结核
B. 支气管肺癌
C. 支气管扩张症
D. 急性支气管炎
E. 肺栓塞

正确答案：C。支气管扩张症

解析：青年患者，突发咳血，查体及胸X线片无明显异常，考虑最可能的诊断为支气管扩张（C对），支气管扩张症部分病入以反复咯血为唯一症状，称为“干性支气管扩张”，病变较轻时X线检查可正常。支气管内膜结核（A错）有低热、盗汗、乏力、咳嗽等症状，且影像学上也有异常，该患者只有咯血。支气管肺癌（B错）多见于 40 岁以上病人，可伴有咳嗽、咳痰、胸痛，痰中带血，大咯血少见。急性支气管炎（D错）年老体弱者易感。症状主要为咳嗽和咳痰，常发生于寒冷季节或气候突变时。肺栓塞（E错）主要表现为呼吸困难、胸痛和咯血，并且有明显的发绀，肺部哮鸣音和（或）细湿啰音等体征，与该患者的表现明显不符。